人类便于取用的河水、湖水及浅层地下水等淡水仅占水圈总水量的
A. 12.0%左右
B. 0.2%左右
C. 0.01%左右
D. 1.0%左右
E. 5.0%左右

正确答案：B。0.2%左右

解析：本题考查水圈的相关内容。人类便于取用的河水、湖水及浅层地下水等淡水仅占水圈总水量的0.2%左右（B对ACDE错）。